某患者，32岁，右下6检查因龋坏已作根管治疗，叩诊（-），无松动，X线片显示根充良好，该牙如要桩冠修复，牙体预备时哪项是错误的
A. 去除病变组织，尽可能保存牙体组织
B. 颈缘不需做肩台预备
C. 如果近远中根管方向一致，可预备成平行根管
D. 在不引起根管侧穿的情况下，尽可能争取较长的冠桩长度
E. 如果髓腔完整，将髓腔预备成一定洞形

正确答案：B。颈缘不需做肩台预备

解析：本题考查桩核冠。为了固位、美观，保证修复体边缘强度、牙周组织健康、冠边缘的封闭，所以要预备肩台（B错，为本题正确答案）。